调查对象因时间久远，难以准确回答而产生的偏倚是
A. 选择性偏倚
B. 无应答偏倚
C. 测量偏倚
D. 回忆偏倚
E. 检查者偏倚

正确答案：D。回忆偏倚

解析：本题考查口腔健康状况调查的样本含量及误差。此题由于让筛查对象回忆时间过于长远的问题，调查对象不能正确回答，由此造成的偏倚，称为回忆偏倚（D对）。